以下生理性与病理性因素中，不影响颅内压力变化的是
A. 脑脊液动力学改变
B. 脑组织血流改变
C. 脑组织肿胀
D. 颅骨的完整性
E. 颅骨密度改变

正确答案：E。颅骨密度改变

解析：颅腔与脑组织、脑脊液和血液是颅内压形成的物质基础。颅骨的完整性（D对）缺损可导致颅腔内容物经缺口向外突出，导致颅内压力降低；脑脊液动力学改变（A对）可导致颅内脑脊液含量变化，导致颅内压力发生变化；脑组织血流改变（B对）可导致颅内血液含量变化，导致颅内压力发生变化；脑组织肿胀（C对）可导致颅内压力升高。颅骨密度改变（E错，为本题正确答案）对颅腔容积及颅腔内容物总量无影响，不影响颅内压力。